患者男性，27岁，左颌下区肿物两月余，触诊为极柔软的囊性肿物，5cm×3cm大小，透光试验阴性，无压痛，应进行的辅助检查是
A. 末梢血象化验
B. 肿物穿刺，必要时行穿刺物涂片
C. 肿物的B型超声波
D. 左颌下腺造影，必要时行CT
E. 左颌下区手术探查及活体组织检查

正确答案：B。肿物穿刺，必要时行穿刺物涂片

解析：本题考查口腔颌面部肿瘤的诊断。根据题干，病变为颌下区一软组织囊性肿物，透光试验阴性，为明确诊断，应根据临床表现结合肿物穿刺，必要时行穿刺物涂片（B对），查看内容物特点进行确诊。活体组织检查是指从病变部位取一小块组织制成切片，在显微镜下观察细胞的形态和结构，以确定病变性质，肿瘤的类型及分化程度等，此方法虽然比较准确可靠，但也要正确掌握，因为不恰当的活体组织检查不但增加患者痛苦，而且可以促使肿瘤转移，根据题干，该患者所患疾病根据临床表现以及穿刺及细胞学检查即可确诊，没有必要进行手术探查及活体组织检查（E错）。末梢血象化验（A错）一般用于血液病，炎性细胞的检查。肿物的B型超声波（C错）只能看出肿物的囊性病变、位置、界限，并不能查其内容物以助诊断。左颌下腺造影（D错）一般用于颌下腺结石病和炎症的诊断。